显微鉴别可见下陷气孔的药材是
A. 麻黄
B. 茵陈
C. 广藿香
D. 蒲公英
E. 益母草

正确答案：A。麻黄

解析：本题考查的是麻黄的显微鉴别。显微鉴别可见下陷气孔的药材是麻黄（A对）。麻黄【显微鉴别】草麻黄茎横切面：①表皮细胞外被厚的角质层；脊线较密，有蜡质疣状凸起，两脊线间有下陷气孔。②下皮纤维束位于脊线处，壁厚，非木化。③皮层较宽，纤维成束散在。④中柱鞘纤维束新月形。⑤维管束外韧型。⑥形成层环类圆形。⑦木质部呈三角状。茵陈（B错）【显微鉴别】茵陈蒿叶粉末：①上表皮细胞壁较平直，下表皮细胞垂周壁波状弯曲。②上、下表皮均有不定式气孔。③腺毛少，顶面观呈鞋底形，常充满淡黄色油状物质，上下表面无明显差异。④表面密布“T”字形非腺毛，具柄部及单细胞臂部。广藿香（C错）【显微鉴别】叶片粉末：淡棕色。①非腺毛1～6细胞，平直或先端弯曲，壁具刺状突起，有的胞腔含黄棕色物质。②叶表皮细胞不规则形，气孔直轴式，副卫细胞清晰可见。③腺鳞头部扁球形，由8个细胞组成，柄单细胞，极短。④小腺毛头部2细胞，柄1～3细胞，甚短。⑤草酸钙针晶细小，散在于叶肉细胞中。⑥间隙腺毛存在于栅栏组织或薄壁组织的细胞间隙中，头部单细胞，呈不规则囊状，柄短，单细胞。蒲公英（D错）【显微鉴别】叶表面观：上下表皮细胞垂周壁波状弯曲，表面角质纹理明显或稀疏可见。上下表皮均有非腺毛，顶端细胞甚长，皱缩呈鞭状或脱落。叶肉细胞含细小草酸钙结晶。叶脉旁可见乳汁管。益母草（E错）【显微鉴别】茎横切面：①表皮细胞外被角质层，有毛茸；腺鳞头部4、6或8细胞，柄单细胞；非腺毛1～4细胞。下皮厚角细胞在棱角处较多。②皮层为数列薄壁细胞。③内皮层明显。中柱鞘纤维束微木化。④韧皮部较窄。⑤木质部在棱角处较发达。⑥髓部薄壁细胞较大。⑦薄壁细胞含细小草酸钙针晶及小方晶。